下列各项，不属母乳喂养优点的是
A. 母乳中含有最适合婴儿生长发育的各种营养素，易于消化和吸收
B. 母乳中含有丰富的抗体、活性细胞和其他免疫活性物质，可增强婴儿抗感染的能力
C. 母乳中饱和脂肪酸较多，有利于脑发育
D. 母乳温度及泌乳速度适宜，新鲜无细菌、污染
E. 初乳中含丰富的SIgA，在胃中不被消化，在肠道中发挥免疫防御作用

正确答案：C。母乳中饱和脂肪酸较多，有利于脑发育

解析：母乳含不饱和脂肪酸多（C错，为本题正确答案），特别是亚油酸较丰富，还含卵磷脂、鞘磷脂以及牛磺酸、DHA，对小儿脑发育十分重要。母乳中含有最适合婴儿生长发育的各种营养素，易于消化和吸收（A对），是婴儿期前4～6月最理想的食物和饮料，如母乳中所含酪蛋白为β-酪蛋白，凝块小；白蛋白为乳清蛋白，均易于消化吸收。母乳中含有丰富的抗体、活性细胞和其他免疫活性物质，可增强婴儿抗感染的能力（B对）。母乳温度及泌乳速度适宜，新鲜无细菌、污染（D对）。初乳中含丰富的SIgA，在胃中不被消化，在肠道中发挥免疫防御作用（E对）。